盐酸异丙肾上腺素气雾剂处方如下：盐酸异丙肾上腺素25g，维生素C1.0g，乙醇296.5g，二氯二氟甲烷适量，共制成1000g，关于该处方中各辅料所起作用的说法，正确的有
A. 乙醇是乳化剂
B. 维生素C是抗氧剂
C. 二氯二氟甲烷是抛射剂
D. 乙醇是潜溶剂
E. 二氯二氟甲烷是金属离子络合剂

正确答案：B、C、D。维生素C是抗氧剂；二氯二氟甲烷是抛射剂；乙醇是潜溶剂

解析：本题考查气雾剂处方中各辅料的作用。盐酸异丙肾上腺素气雾剂处方组成中盐酸异丙肾上腺素为主药，其在抛射剂F12（C对E错）中溶解性能差，加入乙醇做潜溶剂（D对A错），可增加其溶解性；维生素C为抗氧剂（B对）。